脓肿切开引流目的不包括
A. 排出脓液以达消炎解毒目的
B. 减少局部疼痛肿胀
C. 预防窒息发生
D. 预防并发边缘性骨髓炎
E. 切取组织送检

正确答案：E。切取组织送检

解析：本题考查切开引流的目的。切取组织送检用于表浅或有溃疡的肿瘤，不能在坏死部位切取，以免取得坏死组织，得出错误结论（E错，为本题正确答案）。切开引流使脓液排出，可达到消炎解毒的目的（A对）；减少局部疼痛肿胀（B对），预防窒息发生（C对）；预防边缘性颌骨骨髓炎（D对）。